下列关于休克病人预防急性肾衰的措施中不正确的是
A. 及时纠正低血容量性休克，避免肾缺血
B. 矫治休克时不宜使用易引起肾血管收缩的药物
C. 对有溶血倾向的病人应保持肾小管通畅碱化尿液，避免肾小管损害
D. 休克合并DIC时，要及时应用肝素治疗
E. 病人只要出现尿量减少时，要及时使用利尿剂

正确答案：E。病人只要出现尿量减少时，要及时使用利尿剂

解析：休克病人尿量减少是因血容量不足导致肾血流量减少引起，一般休克纠正后尿量可自行恢复，如过早使用利尿药会加重血容量不足而加剧肾脏缺血（E错，为本题正确答案）。当病人发生休克，及时纠正低血容量性休克，避免肾缺血（A对），可有效预防急性肾衰竭；肾血管收缩会加剧肾脏缺血而导致肾衰，因此矫治休克时不宜使用易引起肾血管收缩的药物（B对）；溶血后血红蛋白会阻塞肾小管，故对有溶血倾向的病人应保持肾小管通畅，碱化尿液，避免肾小管损害（C对）；休克合并DIC时，要及时应用肝素治疗（D对），改善高凝状态。